女，36岁。腹泻伴纳差、乏力、消瘦、发热5月余，大便为黄色糊状，3～5次/日。最可能的诊断是
A. 结肠癌
B. 溃疡性结肠炎
C. 克罗恩病
D. 阿米巴肠炎
E. 肠结核

正确答案：E。肠结核

解析：中年女性患者，纳差、乏力、消瘦、发热（结核毒血症状）伴腹泻5月余，粪便呈糊样（符合溃疡型肠结核的表现），最可能的诊断为肠结核（E对）。结肠癌（P382）（A错）多见于中老年患者，以血便为突出表现，有腹痛、腹部肿块等表现。溃疡性结肠炎（P374）（B错）主要表现为反复发作的腹泻、黏液脓血便及腹痛。克罗恩病（P377）（C错）临床以腹痛、腹泻、体重下降、腹块、瘘管形成和肠梗阻为特点。阿米巴肠炎（P375）（D错）无低热、乏力和盗汗等结核毒血症状，粪便中混有黏液和未消化的食物，并有腥臭。